苯丙酮尿症患儿需定期监测
A. 血苯丙氨酸
B. 尿三氯化铁
C. 尿蝶呤
D. 血酪氨酸
E. 尿有机酸

正确答案：A。血苯丙氨酸

解析：苯丙酮尿症需要定期监测血苯丙氨酸（A对），从而可以根据血苯丙氨酸的浓度确定此刻苯丙酮尿症的严重程度。尿蝶呤分析用于鉴定三种非典型苯丙酮尿症（C错）。尿三氯化（B错）和尿有机酸（E错）用于苯丙酮尿症的确诊。血酪氨酸对苯丙酮尿症有辅助诊断的价值（D错）。